铁剂治疗缺铁性贫血的作用机制是
A. 影响酶的活性
B. 影响核酸代谢
C. 补充体内物质
D. 影响机体免疫功能
E. 影响细胞环境

正确答案：C。补充体内物质

解析：本题考查药物的治疗作用。铁剂治疗缺铁性贫血的作用机制是补充体内物质（C对）。补充疗法是指补充体内营养或代谢物质不足，又称替代疗法。例如，补充铁制剂治疗缺铁性贫血；补充胰岛素治疗糖尿病。影响酶的活性（A错）是有机磷中毒的机制。影响核酸代谢（B错）是抗代谢抗肿瘤药的机制。影响机体免疫功能（D错）是免疫调节剂的作用机制。影响细胞环境（E错）是抗酸剂等治疗胃溃疡的机制。